痄腮兼便秘可用
A. 菊花
B. 牛蒡子
C. 蔓荆子
D. 蝉蜕
E. 薄荷

正确答案：B。牛蒡子

解析：牛蒡子辛、苦、寒，归肺、胃经，可疏散风热、宣肺透疹、解毒利咽，可治疗风热感冒，温病初起，咳嗽痰多；麻疹不透，风疹瘙痒；痈肿疮毒，丹毒，痄腮，咽喉肿痛等。其性偏滑利，兼滑肠通便，故痄腮兼便秘可用牛蒡子（B对）。